下列哪项属于胆碱能受体
A. M、α
B. M、β
C. M、α₁和β₁
D. M、α₂、β₂
E. M、N₁和N₂

正确答案：E。M、N₁和N₂